季铵化合物的特性，除外
A. 对革兰阳性菌有较强的杀灭作用
B. 对革兰阴性细菌无效
C. 长期使用可能出现牙染色
D. 制剂在口腔内很快被清除，不能保持疗效
E. 长久使用可促进牙结石的形成

正确答案：B。对革兰阴性细菌无效

解析：季铵化合物系一组阳离子表面活性剂，能杀灭革兰阳性和革兰阴性细菌，特别对革兰阳性菌有较强的杀灭作用，其机制是与细胞膜作用而影响其渗透性，最终细胞内容物丧失。长期使用可能出现牙染色、烧灼感或促进牙结石的形成等副作用。该制剂在口腔内很快被清除，故不能保持疗效。掌握“菌斑控制及提高宿主抵抗力”知识点。